患者因腹泻引起尿量减少的主要机制是
A. 血浆晶体渗透压升高，血管升压素分泌减少
B. 血浆胶体渗透压降低，血管紧张素分泌减少
C. 血浆胶体渗透压降低，血管紧张素分泌增加
D. 血浆晶体渗透压降低，醛固酮分泌增加
E. 血浆晶体渗透压升高，血管升压素分泌增加

正确答案：E。血浆晶体渗透压升高，血管升压素分泌增加

解析：腹泻，机体失水多于溶质的丢失，血浆晶体渗透压升高，视上核及其周围区域渗透压感受器受刺激，使神经垂体释放抗利尿激素（也称血管升压素），集合管管腔膜对水通透性增加，水的重吸收增多，尿液浓缩，尿量减少（E对）。